沿神经传播
A. 庚型肝炎病毒
B. 流感病毒
C. 戊型肝炎病毒
D. 水痘-带状疱疹病毒
E. 鼻病毒

正确答案：D。水痘-带状疱疹病毒